下列关于青春期的描述，哪项是正确的
A. 进入青春期生长激素作用减弱，性激素水平迅速增加
B. 女孩子出现月经是青春期早期发育的主要体征
C. 青春期中期为生长突增阶段
D. 第二性征迅速发育是青春期中期的特征
E. 青春期晚期骨骼愈合，体格发育完全停止

正确答案：D。第二性征迅速发育是青春期中期的特征